关于粉体性质对制剂影响的叙述，错误的是
A. 孔隙率小的粉粒压片时易产生松片或裂片
B. 堆密度差异较大的粉体不易均匀混合
C. 增加粉体的流动性可减小制剂的重（装）量差异
D. 全浸膏片中浸膏粉的孔隙率较小，制片时一般需加用崩解剂
E. 难溶性药物微粉化可因增加其表面积而增加其溶出速率

正确答案：A。孔隙率小的粉粒压片时易产生松片或裂片

解析：本题考查粉体学在药剂中的应用。关于粉体性质对制剂影响的叙述，错误的是孔隙率小的粉粒压片时易产生松片或裂片（A错，为本题正确答案）。（一）对可压性的影响：主要影响的剂型为片剂。影响的主要因素为药物细粉的晶形、形态、大小、粒度等。表面凹凸不平的品体，可以相互嵌合，容易压制成片。堆密度大的疏松颗粒或粉末，由于在压制过程中其中的空气难以完全释放出来，容易造成松库或裂片（B对）。通常细小、粒度分布均匀的粒子具有较大的比表面积，压片时的可压性好，压制成的片剂硬度大，重量差异小。反之，粗大、粒度分布不均匀的粒子，会导致颗粒充填不均匀，片重差异大，而且使压片机的冲头压力分布不均，片剂硬度差，容易产生裂片。降低影响的措施可以采取加入改善可压性能的辅料（微晶纤维素、乳糖等）。（二）对分剂量的影响：散剂、颗粒剂、胶囊剂的分装以及片剂生产，一般都是按容积分剂量，粉粒的堆密度对分剂量的准确性有影响。粉粒的堆密度除决定于药物本身的密度外，还与粒子大小、形态等有关。在分剂量过程中，一般是使粉粒自动流满定量容器，所以其流动性与分剂量的准确性有关，而粉粒的流动性则与粒子大小及分布、粒子形状等有关。在一定范围内，粒子大，流动性好；流动性好的粒子中若加人较多的细粉，有时会令其流动性变差；当粒子大小分布范围很宽时，小粒子可穿过大粒子间的空隙落到底层，因粒子大小不同而导致堆密度不同。粒子的形态规则，表面光滑，其流动性往往较好。增加粉体的流动性可减小制剂的重（装）量差异（B对）。（三）对片剂、丸剂崩解的影响：片剂、丸剂等崩解的首要条件是制剂本身有足够的孔隙。药物细粉的孔隙率及润湿性对固体制剂的崩解有直接影响。全浸膏片没有粉性中药粉末，因而孔隙率极小，通常需加崩解剂进行调节（D对）。（四）对药物疗效的影响：药物的溶解度和溶出速度是多数药物吸收和发挥作用的限速过程，尤其是难溶性药物。通过粉体化的处理，可以使难溶性药物粒径减小、比表面积增大，进而大大提高溶解性能，提高难溶性药物的吸收（E对），有利于药效的发挥。药物的溶出性还与其润湿性有关，疏水性较强的药物仅靠减小粒径增大比表面积，对改善溶出性的作用往往不明显，如果在减小粒径的同时又改善其润湿性，则可取得更好效果。